苦杏仁与紫苏子均有的功效是
A. 止咳平喘
B. 降气化痰
C. 纳气平喘
D. 润肺止咳
E. 润肠通便

正确答案：A、E。止咳平喘；润肠通便

解析：本题考查的是苦杏仁与紫苏子的功效。苦杏仁与紫苏子均有的功效是止咳平喘（A对）与润肠通便（E对）。苦杏仁：【功效】降气止咳平喘，润肠通便。紫苏子：【功效】降气化痰（B错），止咳平喘，润肠通便。磁石：【功效】镇惊安神，平肝潜阳，聪耳明目，纳气平喘（C错）。川贝母：【功效】清热化痰，润肺止咳（D错），散结消痈。